根据《药品广告审查办法》，发布在指定的医学杂志上仅宣传药品名称的处方药广告，可以
A. 无需审查
B. 经国家食品药品监督管理局审查
C. 经省级药品监督管理部门审查
D. 经省级工商行政管理部门审查
E. 经国家工商管理总局审査

正确答案：A。无需审查

解析：本题考查药品广告的界定和管理规定。根据《药品广告审查办法》，发布在指定的医学杂志上仅宣传药品名称的处方药广告，可以无需审查（A对）。药品、医疗器械、保健食品和特殊医学用途配方食品广告中只宣传产品名称（含药品通用名称和药品商品名称）的，不再对其内容进行审查。